孕产期保健不包括
A. 婚前保健
B. 孕前保健
C. 孕早期保健
D. 孕中晚期保健
E. 产褥期保健

正确答案：A。婚前保健

解析：本题考查孕产期保健。孕产期保健是指对准备妊娠到产后42天的妇女、孕产妇及胎婴儿提供的一系列保健服务。包括孕前保健（B对）、妊娠期保健（CD对）、分娩期保健和产褥期保健（E对）等（A错，为本题正确答案）。